在胸骨左缘第3、4肋间触及收缩期震颤，应考虑为
A. 主动脉瓣关闭不全
B. 室间膈缺损
C. 二尖瓣狭窄
D. 三尖瓣狭窄
E. 肺动脉瓣狭窄

正确答案：B。室间膈缺损

解析：在胸骨左缘第三、四肋间触及收缩期震颤，应考虑为室间隔缺损（B对）。主动脉瓣关闭不全时较少有震颤（A错）。二尖瓣狭窄为心尖区触及舒张期震颤（C错）。三尖瓣狭窄为胸骨左缘4～5肋间触及收缩期震颤，但不易触及（D错）。肺动脉瓣狭窄为胸骨左缘第2肋间触及收缩期震颤（E错）。